普伐他汀片的适宜服用时间是
A. 早晨
B. 餐前
C. 餐中
D. 餐后
E. 睡前

正确答案：E。睡前

解析：本题考查药品服用的适宜时间。普伐他汀片适宜在睡前（E对）服用，因为肝脏合成胆固醇高峰期多在夜间，晚餐后服药有助于提高疗效。适宜清晨（A错）服用的药物有糖皮质激素类、抗高血压药物、抗抑郁药、利尿药、驱虫药、泻药。适宜餐前（B错）服用的药物有胃黏膜保护剂、收敛药、促胃动力药、降糖药等。适宜餐中（C错）服用的药物有助消化药、肝胆辅助用药、减肥药、抗结核药。适宜餐后（D错）服用的药物有非甾体抗炎药、维生素、组胺H₂受体阻断剂。